LgG不含的功能区是
A. VH
B. VL
C. CH1
D. CH2
E. CH4

正确答案：E。CH4